类风湿关节炎最常见的关节外表现是
A. 贫血
B. 肺间质病变
C. 心包炎
D. 类风湿结节
E. 周围神经病变

正确答案：D。类风湿结节

解析：类风湿关节炎关节外表现主要有类风湿结节、类风湿血管炎、肺脏受累表现、心脏受累表现、神经系统表现、血液系统表现、Felty综合征、干燥综合征等。其中类风湿结节（D对）最常见。